病室中有尸臭气是因
A. 患者失血
B. 瘟疫发作
C. 脏腑衰败
D. 肾衰
E. 消渴病重

正确答案：C。脏腑衰败

解析：病室尸臭，多为脏腑衰败，病情重笃（C对）。病室有血腥味，多为失血证（A错）。病室臭气触人，多为瘟疫类疾病（B错）。病室有烂苹果样气味，多见于重症消渴病（E错）。